饮水中碘含量与甲状腺肿患病率的曲线关系是
A. U型
B. S型
C. 剂量反应关系
D. 剂量效应关系
E. L型

正确答案：A。U型

解析：本题考查饮水中碘含量与甲状腺肿患病率的曲线关系。饮水中碘含量与甲状腺肿患病率的曲线关系是U型（A对BCDE错）。